齿状韧带
A. 由蛛网膜形成
B. 由硬脊膜形成
C. 其作用是将脊髓的血管固定在椎管上
D. 由软脊膜在脊神经前、后根之间形成
E. 其尖端附于脊髓上

正确答案：D。由软脊膜在脊神经前、后根之间形成

解析：齿状韧带由软脊膜在脊神经前、后根之间形成（AB错D对），其作用是将脊髓固定在椎管内（C错），其尖端附于硬脊膜（E错）。